既疏风止痒、理气止痛，又消疲提神的成药是
A. 驱风油
B. 复方紫草油
C. 京万红
D. 云南白药酊
E. 白花油

正确答案：A。驱风油